牙髓坏死的临床表现为
A. 一般无症状，但X线检查可见牙内吸收
B. 牙齿发暗，变色，不透明，温度及电活力试验无反应
C. 牙齿变色，髓腔内腐败发臭，温度及电活力试验反应迟钝，读数低于对照牙
D. 无明显自发痛，温度改变可引起疼痛
E. 一般无症状，X线可见根管有不均匀膨大

正确答案：B。牙齿发暗，变色，不透明，温度及电活力试验无反应

解析：本题考查牙髓坏死的临床表现。牙髓坏死由各种牙髓炎发展而来，也可因外伤打击等原因导致牙髓坏死，可见牙冠发暗、变色，呈暗红色或灰黄色，变色的原因是牙髓组织坏死后红细胞破裂致使血红蛋白分解产物进入牙本质小管，牙冠不透明，失去光泽。因牙神经已坏死，患者无明显自发痛，坏死的牙髓对温度及电活力试验均无反应（B对D错）。牙髓坏死，患牙一般无自觉症状，X线检查显示患牙根尖周影像无明显变化，未见牙内吸收（A错）。牙髓坏死髓腔内无腐败发臭，温度及电活力试验无反应（C错）。一般无症状，X线可见根管有不均匀膨大（E错），是牙内吸收的特点。